污染的土壤化学性污染来源不包括
A. 钢铁厂工业废水
B. 矿山采掘废水
C. 化工厂工业废水
D. 屠宰场污水
E. 生活污水

正确答案：D。屠宰场污水

解析：本题考查污染的土壤化学性污染来源。污染的土壤化学性污染来源包括：钢铁厂工业废水（A对）；矿山采掘废水（B对）；化工厂工业废水（C对）；生活污水（E对）。屠宰场污水（D错，为本题正确答案）不是污染的土壤化学性污染来源。